不是颈外动脉直接分支的是
A. 面动脉
B. 舌动脉
C. 枕动脉
D. 甲状腺上动脉
E. 脑膜中动脉

正确答案：E。脑膜中动脉

解析：面动脉（A对）、舌动脉（B对）、枕动脉（C对）、甲状腺上动脉（D对）均为颈外动脉的直接分支。脑膜中动脉（E错，为本题正确答案）为上颌动脉的直接分支，是颈外动脉的间接分支。